促进甲状腺激素分泌的激素是
A. TSH
B. ACTH
C. LH
D. GH
E. FSH

正确答案：A。TSH

解析：促进甲状腺激素分泌的激素是促甲状腺激素（TSH）（A对）。促肾上腺皮质激素（ACTH）可以促进肾上腺皮质激素的释放（B错）。黄体生成素（LH）和卵泡刺激素（FSH）可以促进雌激素的分泌（CE错）。生长激素（GH）可以促进人的生长发育（D错）。